正常足月妊娠，子宫腔容量平均比未孕时增加的倍数为
A. 100
B. 200
C. 300
D. 400
E. 1000

正确答案：E。1000